某女，56岁。因患类风湿关节炎，服用壮骨关节丸，每日服2次，每次6g。服药月余后，出现纳差，乏力，尿黄如浓茶色，皮肤黄染瘙痒，大便呈灰白色。遂收入院治疗。入院后进行各项检查，化验检查：ALT316U/L，AST119U/L，ALP276U/L，GGT231U/L，TBiL171μmol/L，各项肝炎病毒学标志物检测均呈阴性。医师综合分析病情，考虑系药物不良反应，给予系统治疗。上述案例提示，为避免或减少壮骨关节丸不良反应的发生，在患者用药前，药师应进行用药指导，重点强调服药疗程、间隔时间及相关检查。关于该药服用方法的描述，正确的是
A. 疗程30天，间隔5天
B. 疗程30天，间隔7天
C. 疗程30天，间隔15天
D. 疗程60天，间隔7天
E. 疗程60天，间隔15天

正确答案：C。疗程30天，间隔15天

解析：本题考查的是中成药的不良反应。关于壮骨关节丸服用方法的描述，正确的是疗程30天，间隔15天（C对）。壮骨关节丸的用药指导：①建议患者应严格遵医嘱用药，避免大剂量、长期连续用药；一旦出现纳差、尿黄、皮肤黄染等症状应及时停药就医。②肝功能不全、孕妇及哺乳期妇女禁用。定期检査肝功能。③30天为一疗程，长期服用者每疗程之间间隔10～20天。